5-氟尿嘧啶最常见的不良反应是
A. 骨髓抑制
B. 过敏反应
C. 急性小脑综合征
D. 消化道反应
E. 肝肾损害

正确答案：D。消化道反应